根据《药品生产质量管理规范》规定，下列药品生产环境空气洁净度级别：100000级适用于
A. 大容量注射剂的灌封
B. 小容量注射剂的灌封
C. 注射剂的浓配
D. 口服固体药品的暴露工序
E. 直肠用药的暴露工序

正确答案：C。注射剂的浓配